基托组织面需局部缓冲的是
A. 正中关系出错
B. 义齿固位差
C. 前牙咬切功能差
D. 下颌隆突处压痛
E. 说话及大开口时义齿脱落

正确答案：D。下颌隆突处压痛

解析：本题考查基托组织面需局部缓冲的情况。下颌隆突处压痛（D对），说明该处义齿组织面缓冲不足，应进行缓冲处理。正中关系出错（A错），应该重新制作义齿。义齿固位差（B错）应该进行基托重衬。前牙切咬功能差（C错）应该重新排列义齿。说话及大开口时义齿脱落（E错），说明义齿固位差，应该进行重衬或基托边缘修整等，加强义齿固位。